一般在移植的数天或数月后发生，主要由细胞免疫应答引起，移植物的主要病理变化是实质细胞的坏死。这种移植排斥反应的类型是
A. 超急排斥
B. 急性排斥
C. 慢性排斥
D. GVHR
E. 以上都不是

正确答案：B。急性排斥